女，50岁。入睡困难、多梦易醒1个月，每周至少3次。同时感到精力疲乏，工作效率下降，对睡眠产生恐惧感，担心免疫力下降，女，50岁。入睡困难、多梦易醒1个月，每周至少3次。同时感到精力疲乏，工作效率下降，对睡眠产生恐惧感，担心免疫力下降，否认情绪低落和消极观念。该患者使用药物治疗的原则是否认情绪低落和消极观念。该患者使用药物治疗的原则是
A. 大剂量冲击疗法
B. 小剂量按需服用
C. 足剂量短疗程
D. 小剂量长疗程
E. 足剂量按需服用

正确答案：C。足剂量短疗程

解析：该患者1个月来，每周至少3次，以入睡困难、多梦易醒为主要表现，同时感到精力疲乏，工作效率下降，引起恐惧感，否认情绪低落和消极观念（排除抑郁症），故诊断为失眠症，药物治疗作为治疗失眠的一种应急对策 ，须合理使用该类药物首先应注意的问题是足剂量和短疗程（C对）。